背侧丘脑腹后外侧核接受
A. 三叉丘系纤维
B. 内侧丘系、脊髓丘系
C. 嗅觉纤维
D. 味觉纤维
E. 无

正确答案：B。内侧丘系、脊髓丘系

解析：背侧丘脑腹后外侧核接受内侧丘系、脊髓丘系（B对）的纤维。背侧丘脑腹后内侧核接受三叉丘系纤维（A错）和由孤束核发出的味觉纤维（D错）。嗅觉纤维（C错）不与背侧丘脑相联系。